应用抗生素头孢哌酮时宜
A. 适当多食脂肪
B. 少食盐
C. 少食醋
D. 不吸烟
E. 不饮酒

正确答案：E。不饮酒

解析：本题考查饮食对药物疗效的影响。应用抗生素头孢哌酮时宜不饮酒（E对）。头孢哌酮可抑制肝药酶的活性，干扰乙醇的代谢，使血中的乙醛浓度增高，出现“双硫仑样反应”，应用抗生素头孢哌酮时应避免饮酒。脂肪（A错）对药效有双重作用，既能降低某些药的疗效，也能增加某些药的疗效。食盐（B错）可影响血液的容量和渗透压。食醋（C错）成分为醋酸，若与碱性药及中性药同服，可发生酸碱中和反应，使药物失效。吸烟（D错）能影响很多药物的吸收、作用和药效。